毛果芸香碱是
A. α受体激动药
B. α受体阻断药
C. β受体激动药
D. β受体阻断药
E. M受体激动药

正确答案：E。M受体激动药